城市生态系统具有自然生态系统的某些共性，同时又具有独特的个性
A. 人为性和不完整性
B. 复杂性和脆弱性
C. 聚集性和稀缺性
D. A＋B
E. A＋B＋C

正确答案：D。A＋B

解析：本题考查城市生态系统的特征。城市生态系统是在城市区域内，由生物群落及其生存环境共同组成的动态系统。城市生态系统具有自然生态系统的某些共性，同时又具有人为性、不完整性、复杂性和脆弱性等独特的个性（D对ABCE错）。